胸腺
A. 位于前纵隔内
B. 具有一定的外分泌功能
C. 成人胸腺相对较大
D. 新生儿和幼儿的胸腺相对较大
E. 无

正确答案：D。新生儿和幼儿的胸腺相对较大

解析：胸腺具有内分泌功能（B错），可分泌胸腺素和促胸腺生成。新生儿和幼儿的胸腺相对较大（D对），胸腺在性成熟后发育至最高峰，随后逐渐萎缩，成人胸腺相对较小(C错）。